某男，75岁，患中风1年，左侧肢软无力，手足浮肿，语言謇涩，面色少华。舌体不正，舌质淡紫，边有痧斑，舌苔薄白，脉细涩无力。治宜选用的中成药是
A. 脑立清丸
B. 血塞通片
C. 通心络胶囊
D. 脑血栓片
E. 复方丹参片

正确答案：C。通心络胶囊

解析：本题考查的是中风的辨证论治。患中风1年，左侧肢软无力，手足浮肿，语言謇涩，面色少华。舌体不正，舌质淡紫，边有痧斑，舌苔薄白，脉细涩无力。治宜选用的中成药是通心络胶囊（C对）。中风是以猝然昏仆，不省人事，半身不遂，口眼㖞斜，语言不利为主症的疾病。病轻者可无昏仆而仅见半身不遂和口眼㖞斜等症状。西医学的急性脑血管疾病，如脑梗死、脑出血、短暂性脑缺血发作和蛛网膜下腔出血等有上述表现者，可参考此内容辨证论治。（一）风痰入络证：【症状】肌肤不仁，手足麻木，突然发生口眼斜，语言不利，口角流涎，舌强语謇，甚则半身不遂，或兼见手足拘挛，关节酸痛等症。舌苔薄白，脉浮数。【中成药应用】常用中成药有大活络丸、再造丸、豨蛭络达胶囊。（二）风阳上扰证：【症状】平素头晕头痛，耳鸣目眩，突然发生口眼斜，舌强语謇，或手足重滞，甚则半身不遂。舌质红苔黄，脉弦。【中成药应用】常用中成药有心脑静片、松龄血脉康胶囊、全天麻胶囊。（三）气虚血瘀证：【症状】肢体偏枯不用，肢软无力，面色萎黄。舌质淡紫或有瘀斑，苔薄白，脉细涩或细弱。【中成药应用】常用中成药有脉络通颗粒、软脉灵口服液、脑安颗粒、消栓胶囊、复方地龙胶囊。脑立清丸（A错）为肝阳头痛的中成药应用。肝阳头痛：【症状】头昏胀痛，两侧为重，心烦易怒，夜寐不宁，口苦面红，或兼胁痛。舌红苔黄，脉弦数。【中成药应用】常用中成药有天麻钩藤颗粒、天麻首乌片、清脑降压片、脑立清丸。中成药应用为血塞通片（B错）、脑血栓片（D错）或复方丹参片（E错）的病证，2022年考试指南未明确说明。